橘红丸适用于
A. 燥咳少痰，质黏难出
B. 咳嗽痰多，不易咯出
C. 咳嗽痰黄，咽喉肿痛
D. 发热恶寒，咳喘气急
E. 阴虚劳嗽，咳痰带血

正确答案：B。咳嗽痰多，不易咯出

解析：本题考查的是橘红丸的主治。橘红丸适用于咳嗽痰多，不易咯出（B对）。橘红丸：【主治】痰热咳嗽，痰多，色黄黏稠，胸闷口干。二母宁嗽丸：【主治】燥热蕴肺所致的咳嗽，症见痰黄而黏不易咳出（A错）、胸闷气促、久咳不止、声哑喉痛（C错）。养阴清肺膏：【主治】阴虚燥咳，咽喉干痛，干咳少痰，或痰中带血（E错）。主治为发热恶寒，咳喘气急（D错）的中成药，2022年考试指南未明确说明。